根据面神经下颌缘支的行径，颌下区的手术切口应
A. 高于下颌骨下缘0.5cm左右
B. 平齐下颌骨下缘0.5cm左右
C. 低于下颌骨下缘0.5～1cm
D. 低于下颌骨下缘1.5～2cm
E. 低于下颌骨下缘2cm以下

正确答案：D。低于下颌骨下缘1.5～2cm

解析：本题考查颌下区的手术切口。面神经下颌缘支自腮腺的下前缘穿出，在下颌角下方前行于颈阔肌深面与颈深筋膜浅层之间，起初行于下颌下三角上部，而后转向上前跨过下颌下缘，行于降口角肌深面。大部分下颌缘支行于下颌骨下缘之上，下颌缘支损伤，可导致患侧口角下垂及流涎。根据面神经下颌缘支的行径，颌下区的手术切口应低于下颌骨下缘1.5～2cm（D对）。